降压作用平稳，持久的钙离子通道阻断剂是
A. 硝苯地平
B. 尼卡地平
C. 尼索地平
D. 尼群地平
E. 拉西地平

正确答案：E。拉西地平

解析：拉西地平独特的高膜亲和力使其血浆半衰期短，多数储存在细胞膜脂质双层深部，形成拉西地平储存库，然后缓慢释放至钙通道产生阻滞效应，所以其持久缓和的舒张血管平滑肌 ，扩张血管，降低外周阻力而平稳持久降压（E对）。